基牙情况较好时，固定义齿桥体颊舌径宽度一般为天然牙的
A. 1/3
B. 1/2
C. 1/4
D. 2/3
E. 3/4

正确答案：D。2/3

解析：本题考查局部固定义齿桥体设计。咬合面的大小与咀嚼效能有关，也与基牙承担的牙合力大小有关。为了减小牙合力，减轻基牙的负担，保持基牙健康，要求桥体的牙合面面积小于原缺失牙的牙合面面积，可通过适当缩小桥体牙合面的颊舌径宽度和扩大舌侧外展隙来达到此目的。桥体牙合面颊舌径宽度一般为缺失牙的2/3（D对）；基牙条件差时，可减至缺失牙宽度的1/2。